下列水体“富营养化”现象中，哪种说法是错的
A. 水中氮磷含量增加
B. 水质感官性状恶化
C. 溶解氧急剧减少
D. 水藻类大量减少
E. 水中微生物死亡

正确答案：D。水藻类大量减少

解析：本题考查水体富营养化现象。水体“富营养化”是指水体中的氮磷含量增加（A对），水质感官性状恶化（B对），溶解氧急剧减少（C对），水藻类大量增加（D错，为本题正确答案），水中微生物死亡（E对）等现象。